肋间内肌可
A. 提肋助呼气
B. 提肋助吸气
C. 降肋助呼气
D. 降肋助吸气
E. 肌束斜向前下方

正确答案：C。降肋助呼气

解析：肋间内肌可降肋助呼气（C对），提肋助吸气（B错）的是肋间外肌。